阴部神经支配
A. 臀大肌
B. 臀中肌
C. 臀小肌
D. 肛门外括约肌
E. 无

正确答案：D。肛门外括约肌

解析：臀大肌（A错）由臀下神经支配。臀中肌（B错）和臀小肌（C错）由臀上神经支配。阴部神经发出肛神经支配肛门外括约肌（D对）和肛门部皮肤。